心室颤动电除颤的正确方法是
A. 必须在心电监测下进行
B. 不能反复多次电除颤
C. 首先需静脉推注安定
D. 非同步电除颤
E. 电击能量一般＜200J

正确答案：D。非同步电除颤

解析：心室颤动时已无心动周期可在任何时间放电，故并不需要必须在心电监测下进行（A错）。直流电非同步电除颤（D对），临床上用于心室颤动，常用能量选择为200~360J（E错），可反复多次除颤（B错）。对于顽固性心室颤动患者，必要时可静脉推注利多卡因或胺碘酮等药；若心室颤动波较纤细，可静脉推注肾上腺素，使颤动波变大，易于转复（C错）。